扶正解表法适用于体虚外感表证，因体虚不同又分为多种治疗方法。下列不属于扶正解表法的是
A. 益气解表法
B. 养血解表法
C. 滋阴解表法
D. 助阳解表法
E. 透疹解表

正确答案：E。透疹解表

解析：本题考查扶正解表法的分类。下列不属于扶正解表法的是透疹解表法（E错，为本题正确答案）。透疹解表法适用于表邪外束，疹毒内陷，麻疹不透之证。症见发热恶风，麻疹透发不出，或出而不畅。舌苔薄黄，脉浮数。扶正解表法适用于体虚外感表证。体虚随气虚、血虚、阴虚、阳虚的不同，又分为益气解表法（A对）、养血解表法（B对）、滋阴解表法（C对）、助阳解表法（D对）四种。